1986年国际移植学会发布的“分配尸体器官的准则”不包含的内容是
A. 将所收集的捐赠器官给以最佳利用
B. 依医学标准将器官给予最适合移植的病人
C. 必须经由国家或地区的器官分配网分配器官
D. 参与移植的医生不应从事该类宣传
E. 不可付钱给捐赠者，但补偿其因手术和住院等所付出的开支和损失是可以的

正确答案：E。不可付钱给捐赠者，但补偿其因手术和住院等所付出的开支和损失是可以的